龋损最常发生的牙面是在
A. 近中邻面
B. 远中邻面
C. 根面
D. 颊面
E. （牙合）面

正确答案：E。（牙合）面

解析：本题考查龋病好发牙面。龋损最常发生的牙面是在（牙合）面（E对）。其次是邻面（AB错）和颊面（D错），随着人口老龄化以及牙周炎患病率的增长，牙龈萎缩导致暴露的牙齿根面（C错）也成为根面龋的好发部位。